计算麻疹疫苗接种后血清检查的阳转率，分子应为
A. 麻疹易感儿数
B. 麻疹患儿数
C. 麻疹疫苗接种人数
D. 麻疹疫苗接种后的阳转人数
E. 麻疹疫苗接种后的阴性人数

正确答案：D。麻疹疫苗接种后的阳转人数

解析：本题考查阳转率。计算麻疹疫苗接种后血清检查的阳转率，分子应为麻疹疫苗接种后的阳转人数（D对ABCE错），分母为疹疫苗接种人数。